下列关于吞咽过程的叙述中，正确的说法是
A. 是一个复杂过程，为吞咽中枢所控制
B. 以自主运动开始，随后为非自主运动
C. 每人每天吞咽约2400次
D. 吞咽活动为一连续过程
E. 以上说法均正确

正确答案：E。以上说法均正确

解析：吞咽是一个复杂过程，为吞咽中枢所控制。这个过程以自主运动开始，随后为非自主运动；其全过程平均仅几秒钟。每人每天吞咽约2400次。婴幼儿期及儿童期的吞咽运动对（牙合）、颌、面生长发育有着不可或缺的作用。吞咽活动为一连续过程，为了便于理解，可根据食团所经过的解剖部位分为口腔阶段、咽腔阶段和食管阶段。掌握“吞咽、呼吸及言语”知识点。